将自身牙根未发育完成的牙完整地摘出，移植于自身其他的缺牙部位，这种方法称为
A. 自体牙移植术
B. 异体牙移植术
C. 即刻再植
D. 延期再植
E. 牙种植术

正确答案：A。自体牙移植术

解析：自体牙移植术，是将自身牙根未发育完成的牙完整地摘出，移植于自身其他的缺牙部位。掌握“牙槽外科”知识点。